阿托品中毒时常见
A. 深昏迷，口唇呈樱桃红色
B. 瞳孔缩小，出汗流涎
C. 瞳孔扩大，谵妄幻觉
D. 深昏迷，瞳孔时大时小
E. 昏迷伴肌纤维颤动

正确答案：C。瞳孔扩大，谵妄幻觉

解析：阿托品为竞争性M胆碱受体阻断药，其作用广泛，各器官对药物的敏感性亦不同。随着剂量增加可出现中毒现象，主要表现瞳孔明显扩大、神志模糊、烦躁不安、抽搐、昏迷和尿滞留等（C对）。深昏迷，口唇呈樱桃红色（A错）为急性一氧化碳中毒的主要临床表现。瞳孔缩小，出汗流涎（B错）属于毒蕈碱样症状（M样症状）主要是副交感神经末梢过度兴奋。深昏迷，瞳孔时大时小（D错）是枕骨大孔疝的主要表现。昏迷伴肌纤维颤动（E错）是有机磷农药中毒的主要表现。